患者，男，16岁。上前牙区牙龈肿大。病史有上颌窦炎，曾消炎治疗。无其他特殊用药史。分析病因
A. 口呼吸
B. 爱吃甜食
C. 药物性龈增生
D. 刷牙方式不正确
E. （牙合）创伤

正确答案：A。口呼吸

解析：本题考查不良习惯的影响。患者男，16岁。上前牙区牙龈肿大。病史有上颌窦炎，曾消炎治疗。无其他特殊用药史（非药物刺激）。上述症状，该患者最可能的病因是口呼吸（A对）。口呼吸常兼有上唇过短,上颌前牙牙龈外露，患龈炎和牙龈肥大的概率较大。爱吃甜食（B错）形成口腔酸性环境，导致牙菌斑附着在牙表面，可能引起龋齿。药物性龈增生（C错）是由于长期服用某种药物而引起，该患者无其他特殊用药史。刷牙方式不正确（D错）引起牙软硬组织的损伤，可能引起牙龈表面的糜烂或溃疡。（牙合）创伤（E错）即牙体在进行运动时由于颌力异常如力量太过或者是颌力方向异常等引起牙周组织的损伤。